属于白三烯受体阻断剂的平喘药是
A. 沙美特罗
B. 孟鲁司特
C. 多索茶碱
D. 布地奈德
E. 噻托溴铵

正确答案：B。孟鲁司特

解析：本题考查孟鲁司特。属于白三烯受体阻断剂的平喘药是孟鲁司特（B对）。白三烯受体阻断剂的平喘药有孟鲁司特、扎鲁司特、普仑司特等。沙美特罗（A错）为长效β₂受体激动剂。多索茶碱（C错）为黄嘌呤类平喘药。布地奈德（D错）为吸入型糖皮质激素。噻托溴铵（E错）为M胆碱受体阻断剂。